全冠黏固后出现牙龈炎，其可能的原因，除了
A. 轴壁突度不良
B. 冠边缘过长
C. 嵌塞食物压迫
D. 试冠、戴冠时对牙龈损伤
E. 牙齿已进行根管治疗

正确答案：E。牙齿已进行根管治疗

解析：修复体粘固后出现龈缘炎的原因：①修复体轴壁突度不良，如短冠修复体轴壁突度不足，食物冲击牙龈。②冠边缘过长，边缘不密合、抛光不良、悬突。③试冠、戴冠时对牙龈损伤。④嵌塞食物压迫。⑤倾斜牙、异位牙修复体未能恢复正常排列和外形。掌握“修复体戴入后的问题及处理”知识点。